浅层起于上颌骨颧突、颧弓下缘前2/3，向下后方走行的是
A. 咬肌
B. 颞肌
C. 翼内肌
D. 翼外肌
E. 舌骨上肌群

正确答案：A。咬肌

解析：咬肌，浅层起于上颌骨颧突、颧弓下缘前2/3，向下后方走行，止于下颌角和下颌支外面的下半部；中层起于颧弓前2/3的深面及后1/3的下缘，止于下颌支的中份；深层起于颧弓深面，止于下颌支的上部和喙突。功能：上提下颌骨并使下颌骨微向前伸，也参与下颌侧方运动。掌握“咀嚼肌、颈部肌及口颌系统肌链”知识点。